有关晶状体的描述，错误的是
A. 是眼的屈光物之一
B. 位于虹膜和玻璃体之间
C. 晶状体周围的皮质为晶状体囊
D. 晶状体核位于晶状体中央
E. 是富有弹性的双凸透镜状结构

正确答案：C。晶状体周围的皮质为晶状体囊

解析：晶状体属于眼球的内容物，是眼的屈光物之一（A对），位于虹膜和玻璃体之间（B对），是富有弹性的双凸透镜状结构（E对）。晶状体囊是晶状体的外面包绕的有高度弹性的薄膜，而非晶状体周围的皮质（C错，为本题正确答案）；晶状体核位于晶状体中央（D对）。